不完全抗原（半抗原）
A. 既有免疫原性，又有免疫反应性
B. 与蛋白质载体偶联后，才能与相应抗体结合
C. 只有免疫原性，而无免疫反应性
D. 既无免疫原性，又无免疫反应性
E. 与抗原决定簇具有相似的含义

正确答案：E。与抗原决定簇具有相似的含义

解析：抗原一般具有两个重要特性，一是免疫原性，二是免疫反应性（抗原性）。只具有免疫反应性的物质称为不完全抗原又称半抗原（ACD错）。既有免疫原性，又有免疫反应性（A错）的物质为完全抗原。免疫反应性是指抗原与其所诱导产生的抗体或致敏淋巴细胞特异性结合的能力，可见，半抗原本身就可以与相应的抗体结合（B错）。抗原决定簇是分子中决定抗原特异性的特殊化学基团，半抗原的抗原性与抗原决定簇具有相似的含义（E对）。